影响骨折愈合的全身因素是
A. 年龄
B. 发热
C. 休克
D. 血压
E. 肥胖

正确答案：A。年龄

解析：影响骨折愈合的因素包括全身因素和局部因素。全身因素包括年龄（A对）、健康状况等。局部因素包括骨折的类型、骨折部位的血液供应、软组织损伤程度、软组织嵌入和感染等。而发热（B错）、休克（C错）、血压（D错）、肥胖（E错）都不是影响骨折愈合的直接因素。